双手X线可见多发对称性梭形软组织肿胀，关节间隙变窄，发生在关节边缘的关节面骨质侵蚀边缘性侵蚀应考虑的疾病是
A. 类风湿性关节炎
B. 双手退行性改变
C. 内生骨软骨瘤
D. 双手结核
E. 双手恶性骨肿瘤

正确答案：A。类风湿性关节炎

解析：双手X线可见多发对称性梭形软组织肿胀，关节间隙变窄，发生在关节边缘的关节面骨质侵蚀边缘性侵蚀应考虑的疾病是类风湿性关节炎。类风湿性关节炎早期局部红肿、疼痛；晚期明显强直，活动受限，手腕及手指向尺侧偏斜（A对）。双手退行性改变主要的病理特点为关节、软骨遭到破坏、变性，软骨下骨硬化，关节边缘和软骨下骨反应性增生，并且由骨赘形成（B错）。内生骨软骨瘤在病灶的外围，小叶的周围有一薄层由软骨内化骨生成的成熟骨，软骨小结节向病灶周围的髓腔增殖，并在骨皮质内层产生锯齿样痕迹（C错）。双手结核，若侵袭骨关节，就是由于结核杆菌侵犯骨关节引起的骨关节疾病（D错）。双手恶性骨肿瘤会出现疼痛、局部肿块、功能障碍等表现（E错）。